GTR手术中用于根面处理的枸橼酸浓度是
A. 10％饱和枸橼酸
B. 20％饱和枸橼酸
C. 30％饱和枸橼酸
D. 50％饱和枸橼酸
E. 70％饱和枸橼酸

正确答案：D。50％饱和枸橼酸

解析：本题考查GTR手术中用于根面处理的枸橼酸浓度。枸橼酸为临床上常用的有机酸，无味，不会引起机体反应和不适,在临床应用中，50%饱和枸橼酸（D对）用于GTR手术中根面处理，可以清洁根面牙石、菌斑，并有消毒灭菌的作用，是常用的根面处理剂。浓度过低的饱和枸橼酸如10%饱和枸橼酸（A错）、20%饱和枸橼酸（B错）、30%饱和枸橼酸（C错）清洁灭菌效果不明显。70%饱和枸橼酸（E错）浓度过高，会引起软硬组织损伤。